将200例某恶性肿瘤患者随机分为两组，分别给子甲，乙两种治疗，并对患者的生存情况进行每年1次，连续6年的随访，其中10例患者失访，采用寿命表法计算得到1年、3年、5年甲法治疗患者生存率分别为95%、79%、65%，乙法治疗患者生存率分别为82%、68%、55%。下列说法正确的是
A. 可估计两种疗法患者的半年生存率
B. 无法估计两种疗法患者的2年生存率
C. 甲法患者1年生存率等于其1年生存概率
D. 甲法患者6年生存率一定大于乙法
E. 甲法患者2年生存率可能小于3年生存率

正确答案：C。甲法患者1年生存率等于其1年生存概率